结核菌素试验原理是
A. Ⅰ型变态反应
B. Ⅱ型变态反应
C. Ⅲ型变态反应
D. Ⅳ型变态反应
E. 人体对外来物质的非特异性反应

正确答案：D。Ⅳ型变态反应

解析：结核菌素试验原理是Ⅳ型变态反应（D对），Ⅰ型变态反应（A错）主要见于过敏反应；Ⅱ型变态反应（B错）多见于输血反应、新生儿溶血病等；Ⅲ型变态反应（C错）多见于Arthus反应、血清病、肾小球肾炎等。非特异性免疫（E错）是生物在长期种系发育和进化过程中形成的一系列天然防御功能，也称固有免疫。